亚硝酸盐中毒解救药物
A. 氯磷定
B. 青霉胺
C. 亚甲蓝
D. 纳洛酮
E. 乙酰胺

正确答案：C。亚甲蓝

解析：本题考查亚硝酸盐中毒解救。亚硝酸盐中毒解救药是亚甲蓝（C对）。氯磷定（A错）适用于有机磷中毒。青霉胺（B错）用于铜、汞、铅中毒的解毒，治疗肝豆状核变性病。纳洛酮（D错）用于急性阿片类中毒（表现为中枢和呼吸抑制）及急性酒精中毒。乙酰胺（E错）（解氟灵）适用于有机氟杀虫农药中毒。